已公布的卫生行政法规是由哪一级机构制定和颁布的
A. 卫生部
B. 国务院
C. 最高人民法院
D. 地方人民政府
E. 人民代表大会

正确答案：B。国务院

解析：我国卫生法律体系1)宪法是我国的根本大法，宪法中有关卫生方面的规定，在我国卫生法律体系中具有最高的法律效力。2)卫生法律：基本法律（由全国人民代表大会通过和颁布）中与医药卫生有关的条款，属于卫生法律体系的内容（如《刑法》），它们在卫生法律体系中的地位和效力低于宪法，高于其他卫生法规。如《中华人民共和国执业医师法》、《中华人民共和国传染病防治法》、《中华人民共和国药品管理法》等。3)卫生行政法规：是国务院发布的关于卫生行政管理方面的规范性文件，如《医疗机构管理条例》、《中医药条例》、《麻醉药品管理办法》、《医疗事故处理条例》等。这类规范性文件在我国卫生法律体系中的地位，低于全国人大常委会制定的卫生法律，高于地方卫生法规，在全国范围内有效。掌握“卫生法的概念、分类和作用”知识点。